HBsAg阳性者，是否具有传染性，应首先检查
A. 肝功
B. 抗HBs
C. HBeAg
D. 抗HBe
E. 抗HBc

正确答案：C。HBeAg